不属于识别HLAⅠ类分子的NK细胞受体是
A. KIR2DL
B. KIR3DL
C. CD94/NKG2A
D. CD94/NKG2C
E. NKG2D

正确答案：E。NKG2D